肾主纳气的生理作用是
A. 摄藏精气于肾
B. 防止水液外泄
C. 防止阳气外脱
D. 封藏五脏精气
E. 防止呼吸表浅

正确答案：E。防止呼吸表浅

解析：本题考查的是肾的生理功能。肾主纳气的生理作用是防止呼吸表浅（E对）。肾主纳气，是指肾有摄纳肺所吸入的清气，保持吸气的深度，防止呼吸表浅的作用。人体的呼吸功能，虽为肺所主，但吸入之气必须由肾摄纳，才能使人体的呼吸保持一定的深度。因此，肾主纳气，对人体的呼吸具有重要意义，只有肾的精气充沛，摄纳正常，才能保证呼吸均匀和调。